关于三叉神经痛患病分支区域内神经功能描述哪项是正确的
A. 痛觉更敏感
B. 触觉减退
C. 温度觉异常
D. 运动支咀嚼功能亢进
E. 以上功能均无变化

正确答案：E。以上功能均无变化

解析：本题考查三叉神经痛患病分支区域内的神经功能。关于三叉神经痛患病分支区域内神经功能描述正确的是功能均无变化（E对）。原发性三叉神经痛一般无论病情轻重，并不影响患侧神经的功能。三叉神经痛的临床检查分为定分支检查和功能检查，以便确定神经径路是否正常。功能检查包括：①感觉功能，可用探针轻划与轻刺患病分支区域内的皮肤与黏膜，若痛觉丧失（A错），再作温度觉检查：以试管盛冷热水试之，如温度觉异常而触觉正常（CB错）时，可能是三叉神经脊束核损害。②角膜反射。③腭反射。④运动功能检查：三叉神经运动支的功能障碍表现为咀嚼肌麻痹（D错），紧咬牙时咬肌松弛无力。